某药厂生产的藿香祛暑胶囊具有祛暑化湿，解表和中功效。其药物组成为广藿香、香薷、白芷、紫苏叶、苍术、丁香、陈皮、大腹皮、法半夏、茯苓、生姜、甘草，辅料为甘油、植物油、明胶、蜂蜡、食用色素。辅料甘油是用作软胶囊囊皮的
A. 增光剂
B. 增塑剂
C. 增稠剂
D. 矫味剂
E. 防腐剂

正确答案：B。增塑剂

解析：本题考查的是软胶囊的囊材组成。辅料甘油是用作软胶囊囊皮的增塑剂（B对）。胶囊剂的囊材：（1）明胶空心胶囊的囊材组成：明胶是空胶囊剂的主要囊材。另外，还要加入适当的辅料，以满足制备和不同产品的要求，保证囊壳的质量要求。常用的有：①增塑剂，如甘油、山梨醇、羧甲纤维素钠等，可增加囊壳的韧性与可塑性。②增稠剂（C错），如琼脂可增加胶液的胶冻力。③遮光剂，如二氧化钛，可防止光对药物氧化的催化，增加光敏性药物的稳定性。④着色剂，如柠檬黄、胭脂红等可增加美观，便于识别。⑤防腐剂（E错），常用对羟基苯甲酸酯类，如羟苯甲酯、羟苯乙酯、羟苯丙酯与羟苯丁酯等，可防止胶液在制备和贮存过程中发生霉变。⑥增光剂（A错），如十二烷基磺酸钠，可增加囊壳的光泽。⑦芳香矫味剂（D错），如乙基香草醛等，可调整胶囊剂的口感等。（2）软胶囊的囊材组成：软胶囊的囊材主要由胶料（胶囊用明胶、阿拉伯胶等）、增塑剂（如甘油、山梨醇等）、附加剂（防腐剂、遮光剂等）和水组成。囊皮的可塑性和弹性与胶料、增塑剂、水的比例密切相关。增塑剂用量过高则囊壁过软，增塑剂用量过低则囊壁过硬。遮光剂、防腐剂、着色剂等辅料与硬胶囊相同。